关于混牙（牙合）特征不正确的是
A. 上唇系带位置过低
B. 中切牙牙间间隙
C. 暂时性前牙拥挤
D. 暂时性近中牙合
E. 暂时性深覆牙合

正确答案：D。暂时性近中牙合

解析：本题考查混合牙列的特征。关于混牙（牙合）特征不正确的是暂时性近中（牙合）（D错，为本题的正确答案）。替牙期的暂时性错（牙合）现象：（1）上颌左右中切牙之间在萌出早期时出现的间隙（B对）；（2）上颌侧切牙初萌时牙冠向远中倾斜；（3）恒切牙萌出时出现轻度拥挤现象（C对）；（4）上下颌第一恒磨牙建（牙合）初期可能为尖对尖（牙合）关系；（5）上下颌切牙萌出早期出现前牙深覆（牙合）（E对）。牙齿初萌时，上唇系带常位于两中切牙之间，表现为上唇系带过低（A对），随着颌骨发育、牙根生长，上唇系带可退缩正常位置。